患有劳力性心绞痛的病人，最佳的治疗方案是
A. 硝酸甘油+硝酸异山梨酯
B. 普萘洛尔+维拉帕米
C. 地尔硫䓬+普萘洛尔
D. 硝酸甘油+普萘洛尔
E. 地尔硫䓬+维拉帕米

正确答案：D。硝酸甘油+普萘洛尔

解析：患有劳力性心绞痛的病人，最佳的治疗方案为硝酸甘油+普萘洛尔（D对）。该方案中硝酸甘油为硝酸酯类药物，为内皮依赖性血管扩张剂，能减少心肌需氧和改善心肌灌注，从而降低心绞痛发作的频率和程度。普萘洛尔为β受体拮抗剂，不仅能降低心肌耗氧量，改善心肌缺血、减少心绞痛发作，而且长期应用可显著降低死亡等心血管事件，目前已作为冠心病二级预防的常规用药。两药合用能协同降低耗氧量，同时β受体拮抗剂能对抗硝酸甘油引起的反射性心率加快和心肌收缩力增强，硝酸甘油可缩小β受体拮抗剂所致的心室前负荷增大和心室射血时间延长，二药合用可互相取长补短（八版药理学P258），因此可作为劳力性心绞痛患者最佳的治疗方案。硝酸甘油+硝酸异山梨酯（A错）方案中两种药物均属于硝酸酯类，联合用药并不能显著增加疗效，却增加不良反应的发生率及程度。维拉帕米和地尔硫䓬都属于非二氢吡啶类钙通道拮抗剂，可抑制心肌收缩，减少心肌耗氧，改善心内膜下心肌血供，缓解心绞痛。其作用机制与普萘洛尔相似，若与普萘洛尔合用，可显著抑制心肌收缩力及传导系统，因此普萘洛尔+维拉帕米（B错）和地尔硫䓬+普萘洛尔（C错）都不是最佳的治疗方案。地尔硫䓬+维拉帕米（E错）为同时使用两种钙通道拮抗剂，更加不合适。